治疗残根最理想的修复体是
A. 嵌体
B. 桩冠
C. 金属全冠
D. 瓷全冠
E. 3/4冠

正确答案：B。桩冠

解析：本题考查桩核冠。当剩余的可利用牙体组织高度不同，尤其是残根时，无法形成足够的全冠固位形，故通常可设计桩冠（B对）修复，由于桩冠可利用嵌入牙根内的桩来固位，因此可取得较强固位力。而嵌体（A错）、金属全冠（C错）、瓷全冠（D错）、3/4冠（E错）在治疗残根时不能获得良好的固位，故临床上不常选用。